男孩，1岁。发热3天，呕吐1次，抽搐1次，既往6个月曾热性惊厥1次。按时预防接种，出生史无特殊。查体：T38.2℃，R30次/分，BP90/55mmHg，颈抵抗（＋），双肺听诊未见异常。心率130次/分，律齐，腹软，肝脾肋下未触及，四肢暖，肌力、肌张力正常。Babinski征（+）。【假设信息】抗生素静脉滴注3天后热退，精神好转。但1周后又发热至38.5℃左右，并呕吐，惊厥1次。最可能出现的的情况是
A. 并发脑脓肿
B. 并发硬膜下积液
C. 并发脑积水
D. 并发脑室管膜炎
E. 院内上呼吸道感染

正确答案：B。并发硬膜下积液

解析：男性幼儿患者，发热3天，呕吐1次，抽搐1次，既往6个月曾热性惊厥1次，颈抵抗（＋），Babinski征（+）。患者有惊厥、颅内压增高表现，综合患者的症状、体征和辅助检查，初步诊断为中枢神经系统感染。【假设信息】抗生素静脉滴注3天后热退，精神好转。但1周后又发热至38.5℃左右，并呕吐，惊厥1次。最可能出现的的情况是并发硬膜下积液（B对）。抗生素对并发脑脓肿（A错）有效，多无复发表现。并发脑积水（C错），患儿表现为烦躁不安、嗜睡、呕吐、惊厥发作，头颅进行性增大，颅缝分离，前囟扩大饱满、头颅破壶音和头皮静脉扩张。并发脑室管膜炎（D错）主要发生在治疗被延误的婴儿。抗生素对院内上呼吸道感染（E错）有效，且多无复发惊厥的表现。